肝胆湿热可见
A. 尿频尿急，尿道灼痛，尿黄短少
B. 头痛目赤，急躁易怒，胁痛便秘
C. 腹部痞闷，纳呆便溏，面目发黄
D. 腹痛下痢，赤白黏冻，里急后重
E. 阴囊湿疹，瘙痒难忍，小便短赤

正确答案：E。阴囊湿疹，瘙痒难忍，小便短赤

解析：肝经绕阴器，过少腹，湿热循经下注，则可见阴囊湿疹，瘙痒难忍；湿热内蕴，则小便短赤。故选项E中的症状为肝胆湿热证的症状（E对）。湿热郁蒸膀胱，气化不行，下迫尿道，故尿频尿急，尿道灼痛；湿热煎熬，津液被灼，则尿黄短少。故选项A的症状为膀胱湿热证的症状，而非肝胆湿热证的症状（A错）。肝火炽盛，循经上攻头目，气血壅滞脉络，故头痛目赤；热扰神魂，心神不宁，魂不守舍，则见急躁易怒；肝火内炽，热灼气阻，则胁痛；火邪灼津，则便秘。故选项B的症状为肝火炽盛证，而非肝胆湿热证的症状（B错）。湿热蕴脾，纳运失健，气机阻滞，则脘腹痞闷，纳呆；湿热下注，阻碍气机，大肠传导失司，则便溏；湿热蕴脾，熏蒸肝胆，疏泄失权，胆汁不循常道而泛溢肌肤，则见面目发黄。故选项C中的症状符合湿热蕴脾的症状，而非肝胆湿热证的症状（C错）。湿热之邪侵犯肠道，阻碍气机，则腹痛；湿热内蕴，损伤肠络，瘀热互结，则下痢赤白黏冻；火性急迫而湿性黏滞，湿热疫毒侵犯，肠道气机阻滞，则里急后重。故选项D中的症状为肠道湿热证的症状，而非肝胆湿热证的症状（D错）。